用高效液相色谱法检查药物中的杂质时，将供试品溶液稀释感与杂质限度相当的溶液作为对照溶液，测定杂质的限量。此方法称为
A. 内标法
B. 外标法
C. 标准加入法
D. 主成分自身对照法
E. 面积归一化法

正确答案：D。主成分自身对照法